治疗慢性肾小球肾炎脾肾气虚证，首选
A. 杞菊地黄丸
B. 真武汤
C. 五皮饮合五苓散
D. 防己黄芪汤
E. 异功散

正确答案：E。异功散

解析：慢性肾小球肾炎脾肾气虚证症状：腰脊酸痛，神疲乏力，或浮肿，纳呆或脘胀，大便溏薄，尿频或夜尿多，舌质淡，舌有齿痕，苔薄白，脉细。治法：补气健脾益肾。方药：四君子汤合肾气丸加减。方药主要以补气为主，纵观选项，只有异功散为补气方剂，又因异功散的组成与四君子汤相似，故异功散为最佳选项（E对）。